阅读中枢位于
A. 额中回后部
B. 距状沟周围皮质
C. 额下回后部
D. 角回
E. 颞上回后部

正确答案：D。角回

解析：阅读中枢位于角回（D对）。额中回后部（A错）为书写中枢所在位置；距状沟周围皮质（B错）为视觉中枢所在位置；额下回后部（C错）为运动性语言中枢所在位置；颞上回后部（E错）为听觉性语言中枢所在位置。